下列关于劳逸损伤与疾病发生关系的叙述，错的是
A. 久视伤血
B. 久坐伤肉
C. 久立伤骨
D. 久思伤心
E. 久行伤筋

正确答案：D。久思伤心

解析：《素问·宣明五气》：“久视伤血（A对）、久卧伤气、久坐伤肉（B对）、久立伤骨（C对）、久行伤筋（E对）”，是谓五劳所伤。脾在志为思，正常思考问题对机体的生理活动并无不良影响，但思虑过度就能影响机体的正常生理活动，其中最主要的是影响气的正常运行，导致气滞与气结。因此思虑过度多影响脾的运化功能，导致脾胃呆滞，运化失常，消化吸收功能障碍，即所谓“思则气结”（D错，为本题正确答案）。